治疗尿路阻塞之癃闭，应首选
A. 桃红四物汤
B. 失笑散
C. 丹参饮
D. 代抵当丸
E. 血府逐瘀汤

正确答案：D。代抵当丸

解析：尿路阻塞之癃闭是由于瘀血败精阻塞于内，阻塞尿路，致水道不通，即浊瘀阻塞证，治宜行瘀散结，通利水道。桃红四物汤功能养血活血，主治血虚兼血瘀证，通利作用弱（A错）。失笑散功能活血祛瘀，散结止痛，主治瘀血停滞证，通利作用弱（B错）。丹参饮功能活血祛瘀，行气止痛，主治血瘀气滞之心胃诸痛（C错）。癃闭浊瘀阻塞证治宜行瘀散结，通利水道，首选代抵当丸（D对）。血府逐瘀汤功能活血祛瘀，行气止痛，主治胸中瘀血证（E错）。